患儿，男，2岁。双侧完全性腭裂，下列不符合其表现的是
A. 常与双侧唇裂同时发生
B. 裂隙在前颌骨部分，各向两侧斜裂
C. 裂隙直达牙槽突
D. 鼻中隔、前颌突及前唇部分孤立于中央
E. 腭垂缺失

正确答案：E。腭垂缺失

解析：本题考查腭裂。腭垂缺失（E错，为本题正确答案）不符合双侧完全性腭裂表现。双侧完全性腭裂：双侧完全性腭裂在临床上常与双侧唇裂同时发生（A对），裂隙在前颌骨部分，各向两侧斜裂（B对），直达牙槽突（C对）；鼻中隔、前颌突及前唇部分孤立于中央（D对）。